肱动脉
A. 行经桡神经沟
B. 沿肱二头肌内侧下行
C. 与肌皮神经伴行
D. 与桡神经伴行
E. 无

正确答案：B。沿肱二头肌内侧下行

解析：肱动脉与正中神经（CD错）伴行沿肱二头肌的内侧（B对）至肘窝。